关于釉质形成缺陷症中钙化不全型叙述不正确的是
A. 为釉质形成缺陷中最常见的类型
B. 常染色体显性、常染色体隐性两种亚型
C. 常染色体隐性型病变相对较轻
D. X线检查示釉质硬度与牙本质相似。
E. 釉基质形成正常但无明显的矿化

正确答案：C。常染色体隐性型病变相对较轻

解析：为釉质形成缺陷中最常见的类型，釉基质形成正常但无明显的矿化，分常染色体显性、常染色体隐性两种亚型。两型均为牙萌出时大小、形态、釉质厚度正常，但釉质很软，因磨耗而很快磨去，常磨至牙龈水平，仅遗留颈部釉质，因颈部釉质钙化较高。由于大部分釉质被磨去，造成牙本质暴露。萌出时釉质黄棕色或橙色，但很快由于色素沉着变为棕至黑色，并有牙石沉积。牙未萌及前牙开（牙合）常见。两种亚型的表现相似，但常染色体隐性型病变常更严重。X线检查示釉质硬度与牙本质相似。掌握“釉质形成缺陷（釉质发育不全）”知识点。